女，19岁。因发热伴头痛，呕吐，烦躁2天，于8月10日入院。查体：T39.8℃，BP130/80mmHg，精神差，问话不能正确回答，颈抵抗，克氏征及巴氏征均阳性。该患病病变最严重的部位是
A. 脑桥和小脑
B. 基底核和丘脑
C. 小脑和延髓
D. 延髓和脑桥
E. 大脑皮层及丘脑

正确答案：E。大脑皮层及丘脑

解析：患者高热伴头痛、呕吐（颅内压升高的症状），颈抵抗、克氏征（脑膜刺激征阳性），考虑颅内感染。颅内感染一般通过脑室与蛛网膜下腔播散，多累及大脑皮层及丘脑（丘脑为网状上行系统的组成部分，受累后可引起意识障碍；语言中枢位于大脑皮质，受累可导致出现听理解及表达障碍）。该患者精神差、烦躁、问话不能正确回答，提示存在意识障碍及语言中枢的受累，故病变最严重的部位是大脑皮层及丘脑（E对）。小脑病变多出现眩晕、姿势异常、平衡障碍等共济失调的症状（P19）；脑桥不同部位病变有不同表现，共同表现有病灶侧眼球不能外展（展神经麻痹）、周围性面神经麻痹（面神经核损害）（P15）；延髓损害时可表现为延髓背外侧综合征（眩晕、恶心、呕吐、Horner综合征等表现）或延髓内侧综合征（对侧肢体中枢性瘫痪等表现）（P15）；基底核病变主要产生运动异常和肌张力改变（P54），综上可知脑桥和小脑（A错）、基底核和丘脑（B错）、小脑和延髓（C错）、延髓和脑桥（D错）均非该患者的病变部位。